全冠龈上边缘的缺点是
A. 易产生继发龋
B. 容易造成菌斑附着
C. 边缘不易密合
D. 在前牙区不美观
E. 易形成肩台

正确答案：D。在前牙区不美观

解析：本题考查全冠龈上边缘的缺点。全冠龈上边缘冠边缘暴露，不美观，不适合用于美观要求高的前牙区（D对）这是全冠龈上边缘的缺点。全冠龈上边缘的优点有边缘菌斑易清洁，不容易造成菌斑附着（B错）；不易产生继发龋（A错）增加了修复的成功性；肩台位于龈上可在直视下预备，易形成肩台（E错）；由于肩台容易制备，且容易获得准确的阴模，冠边缘与肩台易密合（C错）。